WHO推荐的一种调查方法是
A. 普查
B. 随机调查
C. 抽样调查
D. 整群调查
E. 捷径调查

正确答案：E。捷径调查

解析：本题考查WHO推荐使用的调查方法。捷径调查（E对）是WHO推荐使用的调查方法。捷径调查只查有代表性的指数年龄组的人群（5岁、12岁、15岁、35～44岁、65～74岁），此方法经济实用，节省时间和人力，故称为捷径调查。普查（A错）是指在特定时间内，对特定人群中每个成员进行调查，此调查方法工作量大，成本高，不符合WHO推荐使用的调查方法。整群抽样（D错）是抽样调查（C错）的方法之一，以整群为抽样单位，常用于群间差异较小的调查单位；抽样调查需抽取的数量足够大，且调查的数据可靠，不符合WHO推荐使用的调查方法。随机调查（B错）没有明确的调查目的和计划，不符合WHO推荐使用的调查方法。